直接从事供、管水人员患有下列哪些疾病时，不得直接从事供、管水工作
A. 痢疾、伤寒、甲型、戊型病毒性肝炎、活动性肺结核、化脓性皮肤病
B. 痢疾、副伤寒、流感、乙型肝炎、化脓性皮炎
C. 肺结核、痢疾、甲型肝炎、伤寒、化脓性皮炎
D. 痢疾扁桃体炎、活动性肺结核、病毒性肝炎、肿瘤
E. 痢疾、伤寒、恶性肿瘤、化脓性皮肤病、病毒性肝炎

正确答案：A。痢疾、伤寒、甲型、戊型病毒性肝炎、活动性肺结核、化脓性皮肤病

解析：本题考查供管水人员的卫生要求。供管水人员是指供水单位直接从事供水、管水的人员，包括从事净水、取样、化验、二次供水卫生管理及水池、水箱清洗消毒人员。直接从事供、管水人员凡患有痢疾、伤寒、甲型和戊型病毒性肝炎、活动性肺结核、化脓性或渗出性皮肤病（A对BCDE错）及其他有碍生活饮用水卫生的疾病或病原携带者，不得直接从事供、管水工作。